发布进口药广告，应
A. 无需审查
B. 经国家食品药品监督管理局审查
C. 经省级药品监督管理部门审查
D. 经省级工商行政管理部门审查
E. 经国家工商管理总局审査

正确答案：C。经省级药品监督管理部门审查

解析：本题考查药品广告管理。进口药品广告的发布，应当依照前款规定向进口药品代理机构所在地省、自治区、直辖市人民政府药品监督管理部门（C对）申请药品广告批准文号。